WH0建议的结核病病例发现途径是
A. 普查
B. 因症就诊
C. 筛检
D. 定期体检
E. 抽样调查

正确答案：B。因症就诊